覆盖釉质的牙骨质，无功能
A. 无细胞无纤维牙骨质
B. 有细胞固有纤维牙骨质
C. 无细胞固有纤维牙骨质
D. 有细胞混合性分层牙骨质
E. 无细胞外源性纤维牙骨质

正确答案：A。无细胞无纤维牙骨质

解析：无细胞无纤维牙骨质：覆盖釉质的牙骨质属于此种牙骨质，无功能。掌握“牙骨质”知识点。